女，35岁。总担心发生与现实不符的危险，而整日总坐立不安。其临床表现属于
A. 恐惧症状
B. 抑郁症状
C. 强迫症状
D. 焦虑症状
E. 精神分裂症

正确答案：D。焦虑症状

解析：该患者总担心发生与现实不符的危险（精神性焦虑：自由浮动性焦虑），整日总坐立不安（躯体性焦虑）为焦虑症的临床表现（D对）。广泛性焦虑障碍以焦虑为主要临床表现，患者常常有不明原因的提心吊胆、紧张不安，并有显著的自主神经功能紊乱症状、肌肉紧张及运动性不安。患者明知这种担忧是过度的，但不能控制，因此而痛苦。恐惧症和广泛性焦虑障碍都以焦虑为核心症状，但恐惧症的焦虑由特定的对象或处境引起，呈境遇性和发作性，而焦虑障碍的焦虑常没有明确的对象，常持续存在（A错）。抑郁症以情感低落（忧愁、苦闷、唉声叹气、暗自落泪等）为主要表现，本例无此症状，故不考虑（B错）。强迫障碍基本特征为来源于自我的强迫观念和强迫行为，患者认为这些观念和行为没有必要，强迫和反强迫的强烈冲突时患者感到焦虑和痛苦（C错）。 目前，将精神分裂症定义为，一组病因未明的精神病，多起病于青壮年，常有感知、思维、情感、行为等多方面的障碍和精神活动的不协调。一般无意识障碍和明显的智能障碍，病程多迁延（E错）。